位于延髓且与动眼神经副核性质相同
A. 上泌涎核
B. 迷走神经背核
C. 疑核
D. 副神经核
E. 舌下神经核

正确答案：B。迷走神经背核

解析：迷走神经背核（B对）位于延髓且与动眼神经副核性质相同，属于一般内脏运动核。上泌涎核（A错）位于脑桥，属于一般内脏运动核。疑核（C错）、副神经核（D错）位于延髓，属于特殊内脏运动核。舌下神经核（E错）位于延髓，属于一般躯体运动核。